经过气街的经脉是
A. 手少阳与足少阳
B. 足少阴与足太阳
C. 手阳明与足阳明
D. 足厥阴与足太阳
E. 足阳明与足少阳

正确答案：E。足阳明与足少阳

解析：足阳明胃经从胃下口幽门处分出的一支分支，沿腹腔内下行至气街，与直行之脉会合，而后沿大腿前侧下行，至膝膑，向下沿胫骨前缘行至足背，入足第二趾外侧端（厉兑穴）；足少阳胆经从目外眦分出的一支分支，下行进入胸腔，穿过膈肌，络肝，属胆，再沿胁里浅出气街，绕毛际，横向至环跳穴处（E对）。足太阳膀胱经主要循行于头顶、头后部、背部（脊柱正中旁开1.5寸）、下肢外侧后缘（BD错）。手少阳三焦经主要循行于上肢外侧中间、肩部及侧头部（A错）。手阳明大肠经主要循行于上肢外侧前缘、肩部、面部（C错）。